关于眼用制剂的说法，错误的是
A. 滴眼液应与泪液等渗
B. 混悬型滴眼液用前需充分混合
C. 增大滴眼液黏度，有利于提高药效
D. 用于手术后的眼用制剂必须保证无菌，应加入适量抑菌剂
E. 为减少刺激性，滴眼液应使用缓冲液调节溶液的pH，使其在生理耐受范围

正确答案：D。用于手术后的眼用制剂必须保证无菌，应加入适量抑菌剂

解析：本题考查眼用制剂。用于术后的眼用制剂必须满足无菌，但并不加入抑菌剂等附加剂（D错，为本题正确答案）；眼用液体制剂需要与泪液等渗（A对）；混悬型滴眼液容易有沉淀，用前需充分混匀（B对）；滴眼剂黏度增大可延长药物停留时间，增强药效（C对）；滴眼液pH必须调至生理耐受范围，在配制过程中，可用缓冲液调节溶液pH（E对）。